可直接作用于M胆碱受体并产生激动作用的药物是
A. 氯化琥珀胆碱
B. 丁溴东莨菪碱
C. 毛果芸香碱
D. 石杉碱甲
E. 多奈哌齐

正确答案：C。毛果芸香碱